气的生成依赖于
A. 心、肺、肾、肝
B. 肺、脾、肾
C. 心、肺、脾、肝
D. 脾、胃、肺、肾
E. 肺、小肠、肾、三焦

正确答案：D。脾、胃、肺、肾

解析：本题考查的是气的生成。气的生成依赖于脾、胃、肺、肾（D对）。气的生成：气来源于父母先天之精气、后天饮食物中的水谷精微以及从自然界吸入的清气。1.先天之气：先天之气为先天之精所化生，依赖于肾藏精的生理功能，才能充分发挥生理作用。2.后天之气：水谷之精气，依赖于脾胃的运化功能，才能从饮食水谷中化生；自然界的清气，则依赖于肺的呼吸功能，才能吸入人体。因此，气的生成，除与先天禀赋、后天饮食营养，以及自然环境等状况有关外，还与肾、脾胃、肺等脏腑的生理功能密切相关。